机体受外源抗原刺激后，发生免疫应答的部位是
A. 骨髓
B. 淋巴结
C. 胸腺
D. 腔上囊
E. 外周血

正确答案：B。淋巴结